提插补泻法中，泻法的操作手法是
A. 重插轻提，幅度大，频率快
B. 重插轻提，幅度小，频率快
C. 重插轻提，幅度小，频率慢
D. 轻插重提，幅度小，频率快
E. 轻插重提，幅度大，频率快

正确答案：E。轻插重提，幅度大，频率快

解析：该题考查毫针补泻手法。提插补泻中先深后浅，轻插重提，幅度大，频率快，操作时间长者为泻法（E对ABCD错）。